2008年共发生200例某病病人，在2008年年初已知有800例病人，年内因该病死亡40例，年中人口数1000万，如果该病的发生和因该病死亡的事件均匀分布在全年中，则2008年该病的发病率（1/10万）是
A. 2.0
B. 8.0
C. 10
D. 1.6
E. 0.4

正确答案：A。2.0

解析：本题考查发病率。2008年共发生200例某病病人，在2008年年初已知有800例病人，年内因该病死亡40例，年中人口数1000万，如果该病的发生和因该病死亡的事件均匀分布在全年中，则2008年该病的发病率（1/10万）是2.0（A对）。发病率表示在一定期间内，一定人群中某病新发生的病例出现的频率。是反映疾病对人群健康影响和描述疾病分布状态的一项测量指标。发病率=（某时期内某人群中某病新病例人数/同时期内暴露人口数）✕K，其中K=100%、1000‰、10000/万或100000/10万等。发病率=200/100✕100000/10万=2.0。